关于小儿年龄分期，错误的是
A. 婴儿期是指自出生28天后到满1周岁前
B. 胎儿期是指从受精卵开始到胎儿出生为止
C. 学龄前期是指自3周岁后到6～7岁入小学前
D. 新生儿期是指自胎儿出生脐带结扎到满28天
E. 幼儿期是指自1周岁后到满3周岁前

正确答案：A。婴儿期是指自出生28天后到满1周岁前

解析：婴儿期是自出生到1周岁之前（A错，为本题正确答案）。